下列哪项不宜用雌激素治疗
A. 子宫发育不良
B. 功能性子宫出血
C. 中期妊娠引产
D. 过期妊娠引产
E. 先兆流产

正确答案：E。先兆流产

解析：雌激素能增加子宫平滑肌对缩宫素的敏感性，所以对怀疑妊娠的患者均禁忌使用，先兆流产时会增加流产风险或造成流产，故不宜使用（E错，为本题正确答案）。同理则适合中期（C对）或后期妊娠引产（D对）。雌激素的作用即可促进子宫肌细胞增生和肥大；增进血运，促使和维持子宫发育，故可用于子宫发育不良（A对）的治疗。性激素药物治疗是功血的一线治疗，以雌、孕激素联合基础上加用雄激素，可达到止血目的和调整月经周期，故功能性子宫出血（B对）是适宜使用雌激素治疗的。